翼静脉丛的叙述中，不恰当的一项是
A. 主要收集口腔颌面及眼部的静脉血
B. 分布于颞肌及翼内、外肌之间
C. 属于口腔颌面部浅静脉
D. 与颅内、外静脉有广泛的交通
E. 交通静脉可将该处感染扩散蔓延到海绵窦，从而引发颅内感染

正确答案：C。属于口腔颌面部浅静脉

解析：翼静脉丛是口腔颌面部深静脉。翼静脉丛主要收集口腔颌面及眼部的静脉血，这些交通静脉可将该处感染扩散蔓延到海绵窦，从而引发颅内感染。掌握“口腔颌面颈部主要静脉的回流途径与范围”知识点。